含有病原体的动物粪便污染土壤后，通过皮肤传染或黏膜进入人体而得病，该病可能是
A. 血吸虫病
B. 炭疽病
C. 破伤风
D. 蛔虫病
E. 痢疾

正确答案：B。炭疽病

解析：本题考查炭疽病。炭疽病（B对ACDE错）是一种由病原体炭疽芽孢杆菌引起的传染病，它是一种比较常见的细菌性传染病，主要通过动物粪便污染土壤后，通过皮肤传染或黏膜进入人体而得病。